可伴有唇炎、舌炎的口角炎是
A. 营养不良性口角炎
B. 球菌性口角炎
C. 感染性口角炎
D. 接触性口角炎
E. 以上均可

正确答案：A。营养不良性口角炎

解析：营养不良性口角炎：维生素B族缺乏常引起口角炎，尤其是后者，表现为双侧口角湿白色，有糜烂或溃疡，有横的沟裂，严重者可向内侧黏膜或皮肤延伸，沟裂深浅不一，长短不一，疼痛不明显。与口角炎同时存在的还常有唇干燥，有纵裂纹并偶见有鳞屑，唇微肿；舌背丝状乳头萎缩以致舌背平滑。但菌状乳头水肿、肥厚，呈蘑菇样，散在分布，舌缘常见有齿痕。患者感口角处有刺激性痛。因此，营养不良性口角炎，不但口角糜烂还可有唇炎、舌炎。掌握“口角炎”知识点。